只可外用不可内服的药有
A. 红粉
B. 斑蝥
C. 砒石
D. 生甘遂
E. 白降丹

正确答案：A、E。红粉；白降丹

解析：本题考查的是红粉与白降丹的用法用量。只可外用不可内服的药有红粉（A对）、白降丹（E对）。红粉，只可外用，不可内服。外用亦不宜久用；孕妇禁用。白降丹，不可内服，具腐蚀性。斑蝥（B错）【用法用量】外用：适量，研末，或浸酒、醋，或制油膏涂敷患处。内服：炮制后入丸散，0.03～0.06g。砒石（C错）【用法用量】外用：适量，研末撒或调敷、入膏药。内服：入丸散，每次0.002～0.004g。生甘遂（D错）【用法用量】内服：宜入丸散，每次0.5～1.5g。其泻下有效成分不溶于水，醋制可减低毒性。外用：生品适量，捣敷。